肺通气的原动力是
A. 胸内压的变化
B. 肺主动舒缩
C. 呼吸肌的舒缩
D. 外界环境与肺内压力差
E. 肺表面活性物质的作用

正确答案：C。呼吸肌的舒缩

解析：肺通气是气体流动的进出肺的过程，要实现肺通气，必须在肺泡与外界环境之间存在一定压力差。在一定的海拔高度，大气压是相对恒定的，因此肺泡与外界环境之间的压力差是由肺泡内的压力（肺内压）（A错）决定的。肺内压的高低取决于肺的扩张和缩小，但肺自身并不具有主动舒缩的能力（B错），其扩张和缩小依赖于呼吸肌的收缩和舒张引起的胸廓运动。因此，肺通气的原动力是呼吸肌的舒缩（C对）；肺通气的直接动力是外界环境与肺内压力差（D错）。肺泡表面活性物质的作用（E错）是降低肺泡表面张力，增加肺泡的稳定性。